以下几种气体，哪种气体不会引起电击样死亡
A. 氯气
B. 二氧化氮
C. 硫化氢
D. 氰化氢

正确答案：B。二氧化氮

解析：本题考查引起电击样死亡的气体。吸入高浓度氯气（A对）（如3000mg/m³）可引起迷走神经反射性心脏停搏或喉痉挛，出现电击样死亡。H₂S（C对）的强烈刺激，可作用于嗅神经、呼吸道黏膜末梢神经以及颈动脉窦和主动脉体的化学感受器，反射性引起中枢兴奋。但H₂S浓度过高则很快由兴奋转入超限抑制，还可直接作用于延髓的呼吸及血管运动中枢，使呼吸抑制、麻痹、昏迷，导致“电击样”死亡。氰化氢（D对）属于剧毒类毒物，人吸入20～40mg/m³数小时即可出现轻度中毒，150mg/m3接触30分钟后死亡，吸入300mg/m³可无任何先兆突然昏倒，发生“电击样”死亡。二氧化氮（B错，为本题正确答案）是刺激性气体，但不会引发电击样死亡，易造成肺水肿等呼吸系统疾病。